提示系统性红斑狼疮病情活动的是
A. 抗SSA抗体阳性
B. 补体增高
C. 抗双链DNA抗体阳性
D. 抗核抗体阳性
E. 抗Sm抗体阳性

正确答案：C。抗双链DNA抗体阳性

解析：系统性红斑狼疮自身抗体中，抗双链DNA抗体（dsDNA抗体）（C对）与病情活动性密切相关。抗SSA抗体（A错）与病程中出现光过敏、血管炎、皮损等有关，而与病情活动性无关。系统性红斑狼疮补体出现下降时提示病情活动，而不是升高（B错）。抗核抗体阳性几乎见于所有系统性红斑狼疮患者，其对病情活动无提示性（D错）。抗Sm抗体的对系统性红斑狼疮的诊断有重要作用，但对病情活动无提示性（E错）。